甲状腺球蛋白
A. 自身抗原
B. 异种抗原
C. 异嗜性抗原
D. 肿瘤相关抗原
E. 肿瘤特异性抗原

正确答案：A。自身抗原

解析：甲状腺球蛋白是甲状腺滤泡上皮分泌的一种碘化糖蛋白，是组织含有的蛋白质，属于自身抗原（A对）。异种抗原（B错）是指来自另一物种的抗原物质。异嗜性抗原（C错）指存在于人、动物、微生物等不同种属之间的共同抗原。肿瘤相关抗原（D错）指肿瘤细胞和正常组织均可表达的抗原，只是其含量在细胞癌变时明显增高。肿瘤特异性抗原（E错）指肿瘤细胞特有的或只存在于某种肿瘤细胞而不存在于正常细胞的一类抗原。